射精管开口于尿道的
A. 海绵体部
B. 球部
C. 膜部
D. 前列腺部
E. 舟状窝部

正确答案：D。前列腺部

解析：尿道前列腺部（D对）为输精管的开口处。